可致出血性结肠炎的细菌是
A. 霍乱弧菌
B. 副溶血性弧菌
C. 金黄色葡萄球
D. 大肠埃希菌O₁₅₇:H₇
E. 伤寒沙门菌

正确答案：D。大肠埃希菌O₁₅₇:H₇

解析：大肠埃希菌（0157:H7）通过表达志贺毒素，引起上皮细胞微绒毛的A/E损伤，可致出血性结肠炎，患者症状不一，轻则轻度水泻，重至伴剧烈腹痛的血便（D对）。副溶血性弧菌（B错）可致食物中毒，临床表现可从自限性腹泻至中度霍乱样病症，有腹痛、腹泻、呕吐和低热。粪便多为水样，少数血水样，恢复较快，病后免疫力不强，可重复感染。金黄色葡萄球菌（C错）可致化脓性感染和毒素样疾病。化脓性感染一般发生在皮肤，也可波及全身。毒素样疾病包括（1）食物中毒：类似恶心、呕吐、腹泻等急性胃肠炎症状；（2）烫伤样皮肤综合征：多见于婴幼儿和免疫力低下的成人，开始为皮肤红斑，继而发展为内含无菌，液体清亮的泡大疱，轻碰可破，最后表皮脱落；（3）毒性休克综合征：表现为病人突发高热、呕吐等，皮肤弥漫性红疹、低血压、粘膜病变甚至心、肾衰竭导致休克等症状。伤寒沙门菌（E错）可致肠热症，患者出现伤寒等一系列症状。